对化妆品原料的要求中，规定禁用物质421种，其中包括
A. 麻醉药、紫外线吸收剂
B. 抗生素、紫外线吸收剂
C. 防腐剂、激素
D. 精神药物、防腐剂
E. 农药、放射性物质

正确答案：E。农药、放射性物质